细胞体位于牙髓周围与前期牙本质相连处的是
A. 成纤维细胞
B. 成牙本质细胞
C. 树突状细胞
D. T淋巴细胞
E. 巨噬细胞和未分化的间充质细胞

正确答案：B。成牙本质细胞

解析：成牙本质细胞：细胞体位于牙髓周围与前期牙本质相连处，排列成整齐的一层，细胞呈柱状，核卵圆形，位于细胞的基底部。细胞顶端有一长的突起，位于牙本质小管内，成牙本质细胞之间有缝隙连接、紧密连接和中间连接。掌握“牙髓”知识点。